肺炎喘嗽阴虚肺热证的治疗首选方剂是
A. 人参五味子汤
B. 沙参麦冬汤
C. 小青龙汤
D. 麻杏石甘汤
E. 大青龙汤

正确答案：B。沙参麦冬汤

解析：肺炎喘嗽阴虚肺热证的治疗首选方剂是沙参麦冬汤，阴虚肺热证见于肺炎后期，病程迁延，常由痰热闭肺或毒热闭肺证转化而来。临床以干咳少痰，低热盗汗，舌红少津为特征。治法为养阴清肺，润肺止咳。选方沙参麦冬汤加减（B对）。人参五味子汤主治肺炎喘嗽脾肺气虚证（A错）。小青龙汤主治外寒里饮证（C错）。麻杏石甘汤主治外感风邪，邪热壅肺证（D错）。大青龙汤主治外感风寒，兼有里热，恶寒发热，身疼痛，无汗烦躁，脉浮紧（E错）。